关于生物技术药物特点的错误表述是
A. 生物技术药物绝大多数是蛋白质或多肽类药物
B. 临床使用剂量小、药理活性高
C. 在酸碱环境或体内酶存在下极易失活
D. 易透过胃肠道黏膜吸收，多为口服给药
E. 体内生物半衰期较短，从血中消除较快

正确答案：C。在酸碱环境或体内酶存在下极易失活